有助于患者记忆的信息沟通方式不包括
A. 规范使用医学缩略术语
B. 指导问题力求具体
C. 重要医嘱首先提出
D. 语言表达通俗易懂
E. 归纳总结医嘱内容

正确答案：A。规范使用医学缩略术语

解析：通俗表达医学语言，医患交流时，宜采用患者易于理解和接受的通俗词语，将医学用语通俗化，让患者能听明白（A选项为正确选项），B、C、D、E均有助于患者记忆。